目前国内最常见的细菌性痢疾病原菌是
A. 福氏痢疾杆菌
B. 宋氏痢疾杆菌
C. 鲍氏痢疾杆菌
D. 舒氏痢疾杆菌
E. 志贺氏痢疾杆菌

正确答案：A。福氏痢疾杆菌

解析：目前国内最常见的细菌性痢疾病原菌是福氏痢疾杆菌（A对）。